巴豆的主治病证不包括
A. 瘰疬痰核
B. 大腹水肿
C. 寒积便秘
D. 小儿痰食积滞
E. 痈疽脓成未溃

正确答案：A。瘰疬痰核

解析：本题考查的是巴豆的主治病证。巴豆的主治病证不包括瘰疬痰核（A错，为本题正确答案）。巴豆：【主治病证】（1）寒积便秘（C对），腹满胀痛，小儿痰食积滞（D对）。（2）大腹水肿（B对）。（3）寒实结胸，喉痹痰阻。（4）痈肿脓成未溃（E对），恶疮烂肉，疥癣。瘰疬痰核为京大戟的主治病证。京大戟：【主治病证】（1）身面浮肿，大腹水肿，胸胁停饮。（2）痈肿疮毒，瘰疬痰核。